某人因病住院20天，治疗用共53000元，结算费用时被告知其中50000元以下的部分有医保支付，另外3000元需个人支付，该案例中的50000是
A. 起付线
B. 封顶线
C. 自付线
D. 共同付
E. 封底线

正确答案：B。封顶线

解析：低于封顶线的医疗费用由医疗保险支付，本题中50000元以下的部分由医保支付，故本题中50000即为封顶线(B对）｡控制医疗服务需方的措施包括起付线､共同付费､封顶线(CE错）｡起付线(A错）又称扣除保险，是指医疗保险开始支付医疗费用的最低标准，低于起付线的医疗费用由被保险人自负，超出起付线以上的医疗费用由医疗保险按规定支付｡共同付费(D错）又称按比例分担，是指医疗保险机构按照合同或政府的规定对被保险人的医疗费用按一定的比例进行补偿，剩余比例的费用由个人自己支付｡